初产妇，27岁。妊娠32周，阴道少量流血及规律腹痛2小时。肛门检查：宫颈管消失，宫口开大1.5cm。该患者最可能的诊断是
A. 早产临产
B. 胎盘早剥
C. 前置胎盘
D. 晚期流产
E. 先兆临产

正确答案：A。早产临产